安宫牛黄丸是救急的成药，为治疗高热惊厥，神昏谵语之要药，其使用注意事项有
A. 闭证转为脱证者应立即停药
B. 不宜过量或久服
C. 肝肾功能不全者慎用
D. 寒闭神昏者不宜服用
E. 服药期间忌食辛辣食物

正确答案：A、B、C、D、E。闭证转为脱证者应立即停药；不宜过量或久服；肝肾功能不全者慎用；寒闭神昏者不宜服用；服药期间忌食辛辣食物

解析：本题考查的是安宫牛黄丸的注意事项。安宫牛黄丸是救急的成药，为治疗高热惊厥，神昏谵语之要药，其使用注意事项有闭证转为脱证者应立即停药（A对）、不宜过量或久服（B对）、肝肾功能不全者慎用（C对）、寒闭神昏者不宜服用（D对）与服药期间忌食辛辣食物（E对）。安宫牛黄丸：【注意事项】孕妇禁用。寒闭神昏者不宜使用。因其含有毒的朱砂、雄黄，故不宜过量服用或久服，肝肾功能不全者慎用。服药期间，忌食辛辣食物。在治疗过程中如出现肢寒畏冷、面色苍白、冷汗不止、脉微欲绝，由闭证变为脱证者应立即停药。高热神昏、中风昏迷等口服本品困难者，当鼻饲给药。